T细胞识别抗原表位所依赖的分子是
A. 抗体分子
B. 补体分子
C. 细胞因子
D. MHC分子
E. 黏附分子

正确答案：D。MHC分子